女，30岁。活动后心悸、气短2年，1周前受凉后出现咳嗽，咳白痰。有风湿性心脏病二尖瓣狭窄史，查体：高枕卧位，BP90/60mmHg，双肺底可闻及较密的细湿啰音，心率140次/分，心律绝对不齐，S₁强弱不一。治疗首选
A. 西地兰
B. 青霉素
C. 硝普钠
D. 美托洛尔
E. 多巴酚丁胺

正确答案：A。西地兰

解析：患者中青年女性，有风湿性心脏病二尖瓣狭窄史，查体：BP90/60mmHg（正常值90～139/60～89mmHg），双肺底闻及湿啰音，表明患者左心排血量减退并出现肺淤血症状，患者心率140次/分（正常值60～100次/分），心律不齐，S₁（第一心音）强弱变化不定，符合房颤表现，综合患者临床表现、体检和病史，本患者考虑为二尖瓣狭窄合并心房颤动。西地兰（毛花苷C）（A对）最适合用于有快速心室率的心房颤动并心室扩大伴左心室收缩功能不全者（P175），为本例患者治疗房颤首选用药。二尖瓣狭窄（P286）的主要病因为风湿热，青霉素（B错）可用于风湿热的治疗，但是属于长期治疗，对房颤无效。硝普钠（C错）为动、静脉扩张剂，减少回心血量，可用于治疗急性心力衰竭导致的肺水肿，对房颤患者效果不佳。美托洛尔（P389）（D错）属于β受体拮抗剂，通常在洋地黄类药物效果不满意时使用。多巴酚丁胺（P176）（E错）属于β受体兴奋剂，可加快心率，降低外周阻力，增加心肌收缩力，常用于治疗心力衰竭。